KlenowDNA聚合酶是
A. 大肠杆菌DNA聚合酶Ⅰ
B. 大肠杆菌DNA聚合酶Ⅱ
C. 大肠杆菌DNA聚合酶Ⅰ大片段
D. 大肠杆菌DNA聚合酶Ⅲ
E. 水生菌YT1菌株的DNA聚合酶

正确答案：C。大肠杆菌DNA聚合酶Ⅰ大片段